既含有对乙酰氨基酚又含有马来酸氯苯那敏的中成药有
A. 鼻炎康片
B. 维C银翘片
C. 速感宁胶囊
D. 重感灵片
E. 新复方大青叶片

正确答案：B、C。维C银翘片；速感宁胶囊

解析：本题考查的是含西药组分的中成药。既含有对乙酰氨基酚又含有马来酸氯苯那敏的中成药有维C银翘片（B对）与速感宁胶囊（C对）。维C银翘片：功能疏风解表，清热解毒。用于外感风热所致流行性感冒，症见发热、头痛、咳嗽、口干、咽喉疼痛。含西药成分：对乙酰氨基酚、马来酸氯苯那敏、维生素C。速感宁胶囊：功能清热解毒，消炎止痛。用于治疗感冒、流行感冒、咽喉肿痛等。含西药成分：对乙酰氨基酚、马来酸氯苯那敏。鼻炎康片（A错）：功能清热解毒，宣肺通窍，消肿止痛。用于风邪蕴肺所致的急、慢性鼻炎，过敏性鼻炎。含西药成分：马来酸氯苯那敏。重感灵片（D错）：功能解表清热，疏风止痛。用于感冒表邪未解、入里化热所致的恶寒高热、头痛、四肢酸痛、咽痛、鼻塞咳嗽。含西药成分：马来酸氯苯那敏、安乃近。新复方大青叶片（E错）：功能清瘟，消炎，解热。用于伤风感冒，发热头痛，鼻流清涕，骨节酸痛。含西药成分：对乙酰氨基酚、异戊巴比妥、咖啡因、维生素C。